对医德修养的意义的正确表述是
A. 使医务人员养成良好的医德品质和人格，使医疗卫生单位形成良好形象，在医疗竞争中立于不败之地
B. 使医务人员养成良好的医德品质和人格，使医疗卫生单位形成良好的医德医风，从而促进社会精神文明
C. 使医务人员和医疗卫生单位树立良好的形象，从而促进社会精神文明
D. 使医务人员和医疗卫生单位树立良好的形象，在医疗竞争中立于不败之地
E. 使医务人员养成良好的医德品质和人格，使医疗卫生单位形成良好的医德医风，在医疗竞争中立于不败之地

正确答案：B。使医务人员养成良好的医德品质和人格，使医疗卫生单位形成良好的医德医风，从而促进社会精神文明